男，40岁。因急性粒细胞白血病入院。查体：四肢皮肤多处出血点和瘀斑。化验Plt8×10⁹/L。给予单采血小板输注。输注4小时后，患者出现胸闷、呼吸困难。急查胸部X线片可见弥散性阴影。患者最可能发生的输血不良反应是
A. 急性过敏反应
B. 急性溶血反应
C. 细菌性感染
D. 循环超负荷
E. 输血相关急性肺损伤

正确答案：E。输血相关急性肺损伤

解析：输血相关的急性肺损伤是因为供血者血浆中存在白细胞凝集素或HLA特异性抗体所致，一般在输血后1～6小时后发生，主要症状为呼吸困难、肺水肿及低氧血症。患者因为有急性粒细胞白血病，所以白细胞凝集素增高，易发生输血相关的急性肺损伤（E对）。急性过敏反应（A错）多发生在输血数分钟后，表现为荨麻疹、皮疹、支气管痉挛等。急性溶血反应（B错）主要因为血型不符引起，输入后即可出现寒战、高热、腰背酸痛等症状。细菌性感染（C错）表现为寒战、高热、脓血症等。循环超负荷（D错）是输血过量或速度过快导致的心力衰竭，表现为输血中或输血后突发心率加快、呼吸急促、发绀等症状。